骨折愈合过程中血肿机化演进期的完成时间是
A. 3天
B. 5天
C. 1周
D. 2周
E. 3周

正确答案：D。2周

解析：骨折愈合过程中血肿机化演进期一般约需2周（D对ABCE错），原始骨痂形成期一般约需12～24周，骨痂改造塑形期约需1～2年。